不属于克山病的最基本病理改变的是
A. 透明软骨营养不良性变性坏死
B. 软骨内成骨障碍
C. 骨干与骺板骨性愈合
D. 广泛性骨质脱钙
E. 关节增生畸形

正确答案：D。广泛性骨质脱钙

解析：本题考查克山病的最基本病理改变。克山病是一种以心肌变性坏死为主要病理改变的生物地球化学性疾病。其最基本的病理改变是：透明软骨营养不良性变性坏死（A对）；软骨内成骨障碍（B对）；骨干与骺板骨性愈合（C对）；关节增生畸形（E对）。广泛性骨质脱钙（D错，为本题正确答案）是骨质疏松的一种类型。